RNA指导的RNA合成，称为
A. RNA转录
B. RNA编码
C. RNA翻译
D. RNA逆转录
E. RNA复制

正确答案：E。RNA复制

解析：RNA指导的RNA的合成，称为RNA复制。掌握“RNA的生物合成”知识点。